腭部手术的体位是
A. 平卧头正位
B. 平卧头侧位
C. 平卧仰头位
D. 平卧低头位
E. 平卧垫肩头侧位

正确答案：C。平卧仰头位

解析：唇、腭裂手术时应使病人处于头后仰位。此时，声门处于最高位，鼻咽腔处于最低位，血液积存在鼻咽腔而不致流入气管内。掌握“口外手术组织切开、止血及组织分离”知识点。